患者，男，35岁。患支气管哮喘8年，现经常气短喘息，动则加重，倦怠乏力，纳差，腰膝痠软，舌淡胖苔白稍腻，脉细滑。其证型是
A. 肺虚
B. 脾虚
C. 肺脾两虚
D. 肾虚
E. 脾肾两虚

正确答案：E。脾肾两虚

解析：患者患支气管哮喘8年，脾虚健运无权，故纳差，中气不足故倦怠乏力。久病肾虚，摄纳无常，气不归元，故气短喘息，动则加重，精气亏乏，不能充养，故腰膝痠软，舌淡胖苔白稍腻，脉细滑皆为脾肾两虚之侯。故可诊断为脾肾两虚证，治法为健脾益气，补肾纳气，方药选用六君子汤合金贵肾气丸加减。（E对）。肺虚（A错）特点为喘促气短，语声低微，面色㿠白，自汗畏风，咳痰清稀色白，多因气候变化而诱发，发前喷嚏頻作。脾虚证（B错）表现为倦怠乏力，食少便溏，面色萎黄无华，胸脘满闷，恶心纳呆。肺脾两虚（C错）特点为既有肺气虚的自汗畏风，喘促气短，又有脾气虚的食少便溏，胸脘满闷，恶心纳呆。肾虚（D错）的特点为平素息促气短，呼多吸少，腰膝酸软，脑转耳鸣，劳累后发作。